下列抗原属内源性Ag的是
A. 菌体Ag
B. 细菌的外毒素
C. 病毒感染细胞合成的病毒蛋白
D. 异种动物血清
E. 红细胞的Rh抗原

正确答案：C。病毒感染细胞合成的病毒蛋白